主要引起动脉性肺动脉高压的疾病是
A. 睡眠呼吸障碍
B. 慢性阻塞性肺疾病
C. 二尖瓣狭窄
D. 特发性肺动脉高压
E. 肺动脉栓塞

正确答案：D。特发性肺动脉高压

解析：特发性肺动脉高压是动脉性肺动脉高压最常见的病因（D对）。睡眠呼吸障碍（A错）、慢性阻塞性肺疾病（B错）引起的是肺部疾病和（或）低氧所致肺动脉高压。二尖瓣狭窄（C错）引起的是左心疾病所致肺动脉高压。肺动脉栓塞（E错）引起的是慢性血栓栓塞性肺动脉高压。